患者左上后牙半年来咬物不适，偶有咬到某一处时锐痛。检查：左上4567未见龋及牙周袋，左上6近中（牙合）面可疑裂纹，冷敏感，X线未见异常。该牙患以下哪种疾病的可能性最大
A. 楔状缺损
B. 磨损
C. 隐裂
D. 磨牙症
E. 慢性牙髓炎

正确答案：C。隐裂

解析：本题考查牙隐裂。患者左上后牙半年来咬物不适，偶有咬到某一处时锐痛。检查：左上4567未见龋及牙周袋，左上6近中（牙合）面可疑裂纹，冷敏感，X线未见异常。该牙患隐裂（C对）的可能性最大。患者左上后牙半年来咬物不适，偶有咬到某一处时锐痛，即患者有定点性撕裂样疼痛的表现；检查见左上4567未见龋及牙周袋，可排除由龋病和牙周病变导致疼痛的可能；左上6近中（牙合）面可疑裂纹，冷敏感，X线未见异常，可考虑是由左上6牙隐裂引起的后牙咬物不适。楔状缺损在口内检查时可以看到或用探针探到牙颈部的缺损（A错）。磨损可导致牙齿的尖窝沟嵴模糊，或出现高耸的牙尖和锐利的边缘嵴，在口内检查时均可发现（B错）。磨牙症是在非进食情况下发生的不自主的咀嚼运动，多在夜间睡眠中发生，往往会导致明显的牙齿磨损（D错）。慢性牙髓炎检查时可查及患牙有深龋洞或深牙周袋等导致牙髓感染的途径（E错）。